高处坠落致脊髓损伤的患者，来院后哪项检查，最能准确的确定脊髓损伤的平面
A. 检查感觉平面
B. 检查肢体的运动
C. 检查肢体的温度
D. MRI检查
E. X线平片

正确答案：D。MRI检查